下列疾病中除哪项外均可见脉压增大
A. 主动脉瓣关闭不全
B. 主动脉瓣狭窄
C. 动脉导管未闭
D. 严重贫血
E. 老年主动脉硬化

正确答案：B。主动脉瓣狭窄

解析：脉压增大，指的是脉压>40mmHg，可见于主动脉瓣关闭不全（A对）、动脉导管未闭（C对）、严重贫血（D对）、老年主动脉硬化（E对）。主动脉瓣狭窄（B错，为本题正确答案）时收缩压降低，舒张压变化不大，故表现为脉压减小。